最准确的药物定量构效关系的描述应是
A. 拓朴学方法设计新药
B. Hansch方法
C. 数学模式研究分子的化学结构与生物活性关系的方法
D. Free-Wilson数学加和模型
E. 统计学方法在药物研究中的应用

正确答案：C。数学模式研究分子的化学结构与生物活性关系的方法